缩写DSC是指
A. 气相色谱法
B. 高效液相色谱法
C. 十八烷基硅烷键合硅胶
D. 红外分光光度法
E. 差示扫描量热法

正确答案：E。差示扫描量热法